下列哪项不是门脉高压的临床表现
A. 腹腔积液
B. 食管静脉曲张
C. 脾大
D. 末梢血象全血细胞减少
E. 蜘蛛痔、肝掌

正确答案：E。蜘蛛痔、肝掌

解析：本题考查肝硬化。蜘蛛痔、肝掌（E错，为本题正确答案）不是门脉高压的临床表现。门脉高压症：脾大、侧支循环建立和开放、腹水是门脉高压症的三大临床表现。①脾大（C对）：脾脏因长期淤血而大，多为轻、中度肿大，消化道出血后可暂时性缩小。脾大伴有血细胞减少，称为脾功能亢进。②侧支循环建立和开放：临床上有二支重要的侧支循环开放，即食管和胃底静脉、腹壁静脉、痔静脉。食管和胃底静脉曲张（B对）是肝硬化的特征性表现。末梢血象全血细胞减少（D对）。③腹水（A对）：是肝硬化失代偿期最常见和最突出的表现。腹水形成的机制：门静脉压力增高；低蛋白血症；继发性醛固酮和抗利尿激素增多。